可见病变部位肿块坚硬如石，高低不平，固定不移症状的是
A. 结核肿块
B. 瘤
C. 瘿
D. 岩
E. 血管瘤

正确答案：D。岩

解析：岩是发生于体表的恶性肿物的统称，质地坚硬，表面凹凸不平，位置固定不移（D对）。结核肿块（A错）一般不易摸到，多发生在脏器，若发生在乳房可触及乳房软硬不一。瘤（B错）的临床特点为局限性肿块，发展缓慢，肿块表面光滑，与周围组织不粘连，推之可移。瘿（C错）是甲状腺疾病的总称，临床有气瘿、肉瘿、石瘿及瘿痈之分。血管瘤（E错）位置较深者只能通过影像手段诊断，位置较浅者可触及血管搏动等。